吗啡不用于慢性钝痛是因为
A. 治疗量就能抑制呼吸
B. 对钝痛的效果欠佳
C. 连续多次应用易成瘾
D. 引起体位性低血压
E. 引起便秘和尿潴留

正确答案：C。连续多次应用易成瘾